增强桩冠固位的方法哪项是错误的
A. 尽可能多保存残留牙冠组织，以增加冠桩的长度
B. 根管预备成椭圆形，减小根管壁的锥度
C. 尽可能利用根管的长度，需要时冠桩可达根尖
D. 根颈部做肩台预备，增加冠的稳定性
E. 用铸造冠桩增加冠桩与根管壁的密合度

正确答案：C。尽可能利用根管的长度，需要时冠桩可达根尖

解析：本题考查增强桩冠固位的方法。根管长度应适当增长，一般桩的长度不短于临床牙冠的长度，骨内桩长度大于骨内根长度的1/2，必须保留不少于4毫米的根充材料隔离口腔与根尖周。如果为了尽可能利用根管的长度，冠桩达根尖（C错，为本题的正确答案）会破坏根尖封闭，引起根尖周病变。增强桩冠固位可以尽可能多保存残留牙冠组织，使根尖到可用牙冠的高度增加，以增加冠桩的长度（A对），同时能够获得足够的牙本质肩领，增强剩余牙体组织的抗折力。椭圆形结构比圆形结构有更好的固位力，根管预备成椭圆形，相对圆形来说固位更稳定；减小根管壁的锥度（B对），若预备的桩锥度太大，根管桩不但容易脱出而且强度不好易折断。根颈部做肩台预备，使牙冠有一定的支撑，以增加冠的稳定性（D对）。铸造冠桩是根据预备好的桩道取模然后加工制作，相对于成品的玻璃纤维桩精确度更高，不仅可以增加冠桩与根管壁的密合度（E对），同时还可以增强冠桩的强度。